碘酊用于口腔黏膜消毒常用的浓度为
A. 0.005
B. 0.01
C. 0.02
D. 0.03
E. 0.05

正确答案：B。0.01

解析：本题考查碘酊消毒。碘酊用于口腔黏膜消毒常用的浓度为1%（B对）。碘酊杀菌力强，但刺激性大，故在不同部位使用浓度不同：消毒颌面颈部为2%，口腔内为1%，头皮部为3%。使用后应予脱碘，碘过敏者禁用。